环境卫生学的基本理论为
A. 人与环境之间的统一性
B. 环境因素对机体影响的作用机制
C. 机体对环境的适应能力
D. 阐明环境因素对健康影响的复杂性
E. 环境中有益因素和有害因素对机体的综合作用

正确答案：A。人与环境之间的统一性

解析：本题考查环境卫生学的基本理论。环境卫生学（A对）的基本理论是人与环境之间的辩证统一关系，该理论为开展环境与健康关系的研究提供了重要的理论基础。